用手指轻推外表正常的皮肤或黏膜即可迅速形成水疱，称为
A. 揭皮试验阳性
B. 表皮松解症
C. 尼氏征阳性
D. OT试验阳性
E. 青霉素试验阳性

正确答案：C。尼氏征阳性

解析：本题考查尼氏征阳性。用手指轻推外表正常的皮肤或黏膜即可迅速形成水疱，称为尼氏征阳性（C对），尼氏征常出现于活跃期的寻常型和落叶型天疱疮，是比较有诊断价值的检查方法。 揭皮试验阳性（A错）指寻常型天疱疮的口腔病损出现水疱后，若将疱壁撕去或提取时常连同邻近外观正常的粘膜一并无痛性的撕去，并遗留下一鲜红的创面。表皮松解症（B错）指棘层松解上皮内疱形成，疱壁薄而松弛，见于大疱性天疱疮。OT试验阳性（D错）指手臂做OT试验测试时出现红包，表明患者可能患有结核病。青霉素试验阳性（E错）指就是抽取皮试液作皮内注射成一皮丘，等20min后，如局部出现红肿，直径大于1cm或局部红晕或伴有小水泡者为阳性。